供试品与硝酸共热，得黄色产物，放冷后加醇制氢氧化钾少许，即显深紫色。此反应可鉴别的药物是
A. 盐酸麻黄碱
B. 硫酸阿托品
C. 盐酸吗啡
D. 硫酸奎宁
E. 硝酸士的宁

正确答案：B。硫酸阿托品